患儿，2岁。发热咳嗽，气急鼻煽，喉中痰声漉漉，两肺可闻及细小水泡音，舌红苔黄腻。其证候是
A. 风热闭肺
B. 痰热闭肺
C. 风热咳嗽
D. 痰热咳嗽
E. 痰湿咳嗽

正确答案：B。痰热闭肺

解析：患儿发热、咳嗽，气急、鼻煽，两肺可闻及细小水泡音可诊断为肺炎喘嗽；喉中痰声漉漉，舌红，苔黄腻为痰热交结，壅于气道所致，故可诊断为痰热闭肺之肺炎喘嗽（B对）。风热闭肺证症见发热恶风、咳嗽气急、痰黄黏稠（A错）。风热咳嗽证症见咳嗽不爽，痰黄黏稠，不易咯出，口渴咽痛，鼻流浊涕，伴有发热恶风，头痛，微汗出，舌质红，苔薄黄，脉浮数或指纹浮紫（C错）。痰热咳嗽以咳嗽痰多，色黄粘稠，难以咯出为特征（D错）。痰湿咳嗽证症见咳嗽重浊，痰多壅盛，色白而稀，喉间痰声漉漉，胸闷纳呆，神乏困倦，舌淡红，苔白腻，脉滑（E错）。